导致血浆二氧化碳分压降低的原因是
A. 麻醉药应用过量
B. 严重的喉头水肿
C. 严重的低钾血症
D. 高热
E. 气管异物

正确答案：D。高热

解析：高热（D对）。时血温过高和机体分解代谢亢进可刺激引起呼吸中枢兴奋，通气过度使PaC02 降低，引起呼吸性碱中毒。麻醉药应用过量（A错）、严重的喉头水肿（B错）和气管异物（E错）时CO2无法排出导致血浆二氧化碳分压升高；严重的低钾血症（C错）可导致代谢性碱中毒，呼吸代偿性减慢，血浆二氧化碳分压升高。